哪一类水、钠代谢障碍更易发生休克？
A. 低渗性脱水
B. 等渗性脱水
C. 高渗性脱水
D. 水中毒
E. 原发性高钠血症

正确答案：A。低渗性脱水

解析：低渗性脱水（A对）时细胞外液的水向渗透压相对高的细胞内转移，加重细胞外液水的丢失而易发生休克。高渗性脱水（C错）由于细胞外液高渗，可使渗透压相对较低的细胞内液向细胞外转移，这有助于循环血量的恢复。水中毒（E错）体液量明显增多，一般无休克。